下列哪项不属于气的运动形式
A. 降
B. 聚
C. 升
D. 散
E. 合

正确答案：E。合

解析：升（C对）、降（A对）、出、入、聚（B对）、散（D对）是气运动的基本形式（E错，为本题正确答案）。